tRNA的3'端结构是
A. GPPPmG结构
B. 多聚A结构
C. hnRNA
D. 假尿嘧啶核苷
E. CCA-OH结构

正确答案：E。CCA-OH结构